葛根的主治病证有
A. 消渴证
B. 背项强痛
C. 肺热燥咳
D. 湿热泻痢初起
E. 麻疹透发不畅

正确答案：A、B、D、E。消渴证；背项强痛；湿热泻痢初起；麻疹透发不畅

解析：本题考查的是葛根的主治病证。葛根的主治病证有消渴证（A对）、背项强痛（B对）、湿热泻痢初起（D对）与麻疹初起透发不畅（E对）。葛根：【主治病证】（1）外感表证，项背强痛。（2）麻疹初起透发不畅。（3）热病烦渴，消渴证。（4）湿热泻痢初起，脾虚泄泻。桑叶：【主治病证】（1）风热感冒或温病初起之咳嗽头痛。（2）肺热燥咳（C错）。（3）肝阳眩晕，目赤肿痛，视物昏花。（4）血热吐衄。